应用抗癌药物疗效最佳的是
A. 原发性卵巢癌
B. 卵巢转移癌
C. 子宫颈癌
D. 子宫内膜癌
E. 绒毛膜癌

正确答案：E。绒毛膜癌

解析：应用抗癌药物疗效（化疗）最佳的是绒毛膜癌（E对），几乎全部无转移和低危转移患者均能治愈。原发性卵巢癌（P325）（A错）以手术治疗为主，术后根据其组织学类型、细胞分化程度、手术病理分期和残余灶大小决定是否接受辅助性治疗，化疗是主要的辅助治疗。其中卵黄囊瘤对化疗十分敏感，现经手术及联合治疗，生存期明显延长。卵巢转移癌（P331）（B错）对化疗、放疗反应差，治疗效果不佳，预后差，主要用于缓解和控制症状。子宫颈癌（P308）（C错）和子宫内膜癌（P316）（D错）以手术治疗为主，化疗是其综合治疗的一种措施，主要用于晚期或复发转移患者。